男，32岁。周期性空腹及夜间上腹痛4年，饱食后突发剧烈上腹痛3小时。查体：上腹部腹肌紧张，压痛阳性。肝浊音界消失。该患者目前最适合的治疗是
A. 质子泵抑制剂治疗
B. 雷尼替丁治疗
C. 根除幽门螺旋杆菌治疗
D. 手术治疗
E. 胶体铋剂治疗

正确答案：D。手术治疗

解析：该患者疑诊为十二指肠溃疡急性穿孔，且为饱食后穿孔，已有较明显的腹膜炎体征，首选手术治疗（D对）。质子泵抑制剂治疗（A错）、雷尼替丁治疗（B错）、根除幽门螺杆菌治疗（C错）以及胶体铋剂治疗（E错）均适用于消化性溃疡未穿孔时，一旦穿孔，最适合的治疗即为手术。